婴儿刚出生不久在牙龈上可以观察到Serre上皮剩余，表现为针头大小的白色突起，称为
A. 上皮珠
B. 角化珠
C. 走马牙疳
D. 成釉器
E. 牙板

正确答案：A。上皮珠

解析：牙板的残余上皮称为Serre上皮剩余，在婴儿刚出生不久，可以表现在其牙龈上，为针头大小的白色突起，称为上皮珠，俗称马牙，可自行脱落。掌握“牙体、牙周组织的形成”知识点。